轻度妊高征初产妇，孕39周，临产，宫口开全1小时，LOA，S+3，胎心110次/分，羊水轻度胎粪污染，此时应采取的措施是
A. 人工破膜
B. 剖宫产
C. 引产
D. 会阴侧切
E. 低位产钳术

正确答案：E。低位产钳术

解析：轻度妊高症初产妇，妊娠39周，宫口开全1小时，枕左前位（LOA），S+3（胎头下降至坐骨棘平面以下3cm），胎心110次/分（胎心110～160次/分），羊水轻度胎粪污染，考虑阴道试产，不需要进行剖宫产（B错），可采取低位产钳术（E对）助娩，若胎头过大不能顺利通过阴道口可考虑会阴侧切（D错）。由于子宫乏力等因素不能自己破膜的才需人工破膜（P189）（A错）。引产（实用妇产科学第2版P1020）（C错）是妊娠14周后，因母体和胎儿方面的原因，需要人工方法诱发子宫收缩而结束妊娠，该产妇情况良好，不需引产。